属于牙膏中润湿剂的是
A. 薄荷
B. 丙三醇
C. 苯甲酸盐
D. 二氧化硅
E. 月桂醇硫酸钠

正确答案：B。丙三醇

解析：润湿剂：占20%～40%。其作用是保持湿润，防止接触空气而硬化，并使剂型保持稳定，常用的有甘油（丙三醇），聚乙二醇和山梨醇，这些制剂需要防腐，以便阻止微生物生长。掌握“自我口腔保健方法”知识点。